女，28岁。妊娠28周，2小时糖耐量试验血糖水平依次为5.0、9.5、10.0及8.5mmol/L，一周后早餐后2小时血糖为8.7mmol/L，患者系初次妊娠，既往无糖尿病史，诊断为
A. 糖耐量正常
B. 妊娠期糖耐量减低
C. 妊娠期糖尿病
D. 糖尿病合并妊娠
E. 特殊类型糖尿病

正确答案：C。妊娠期糖尿病

解析：28岁初孕妇，妊娠28周，既往无糖尿病史，空腹血糖5.0mmol/L（A错）（4.4mmol/L≤空腹血糖＜5.1mol/L者，应尽早做口服糖耐量试验），口服葡萄糖耐量试验30min血糖9.5mmol/L，1小时血糖10.0mmol/L（达到诊断标准10.0mmol/L），2小时血糖8.5mmol/L（达到诊断标准8.5mmol/L），一周后早餐后2小时血糖8.7mmol/L（正常妊娠期餐后2小时血糖4.4～6.7mmol/L），应诊断为妊娠期糖尿病（C对）。妊娠期糖耐量减低（B错）是指出现了血糖升高，但是血糖升高的程度还未达到糖尿病的诊断标准。糖尿病合并妊娠（D错）是在原有糖尿病的基础上合并妊娠。特殊类型的糖尿病（E错）是指病因学相对明确的一些高血糖状态，如青年人中的成年发病型糖尿病（MODY）、线粒体基因突变糖尿病、妖精貌综合症等（八版内科学P733）。